初产妇，31岁。宫口已开全，阴道检查胎头矢状缝与骨盆横径一致，小囟门在9点，大囟门在3点属于哪种胎位
A. LOT
B. ROT
C. LOA
D. ROA
E. LOP

正确答案：B。ROT

解析：初产妇，宫口已开全，阴道检查胎头矢状缝与骨盆横径一致（提示横位），小囟门在9点，大囟门在3点，小囟门在解剖学上紧邻枕骨，所以说明枕骨在右侧，所以属于右枕横位（ROT）（B对）。